由动物毒性试验结果外推到人时，鉴于动物与人的种属和个体之间的生物学差异，一般采用的不确定性系数为
A. 10倍
B. 50倍
C. 100倍
D. 500倍
E. 1000倍

正确答案：C。100倍

解析：本题考查不确定系数。由动物毒性试验结果外推到人时，鉴于动物与人的种属和个体之间的生物学差异，一般采用的不确定性系数为100倍（C对ABDE错）。